盒形洞的基本特点，下列哪一条是错误
A. 洞底要平
B. 线角要圆钝
C. 要有一定深度
D. 洞壁内倾

正确答案：D。洞壁内倾

解析：本题考查盒状洞形的特点。盒形洞的基本特点错误的是洞壁内倾（D错，为本题的正确答案）。盒形洞是窝洞抗力形的一种，其基本特点是洞底要平（A对），点、线角要圆钝（B对），侧壁平面与洞底垂直，使咬合力分布均匀，避免应力集中；如果洞壁内倾，则会形成无基釉，承受（牙合）力时，易引起牙体组织折裂。盒状洞形要有一定深度（C对），一般洞深在釉牙本质下0.2～0.5mm，使充填体有足够的厚度，从而获得足够的抗力。